易发生冻结的药物是
A. 白陶土
B. 氢氧化铝凝胶
C. 毒毛旋花子苷
D. 酚磺乙胺
E. 甘油

正确答案：B。氢氧化铝凝胶